原发性三叉神经痛患者无论病程长短，神经系统检查无阳性体征发现，仍保持罹患分支区域内的痛觉、触觉和温度觉的感觉功能和运动支的咀嚼肌功能。神经功能检查不包括的项目是
A. 泪液检查
B. 温痛觉检查
C. 角膜反射
D. 腭反射
E. 运动功能检查

正确答案：A。泪液检查

解析：泪液检查目的在于在面神经损害时观察膝状神经节是否受损。掌握“三叉神经痛”知识点。